朊粒引起的主要疾病是
A. 狂犬病
B. 克雅病与库鲁病
C. 艾滋病
D. 莱姆病
E. 恙虫病

正确答案：B。克雅病与库鲁病